结构为二萜类化合物的是
A. 紫杉醇
B. 穿心莲内酯
C. 苯丙酸
D. 苯乙酸
E. 苯甲酸

正确答案：A、B。紫杉醇；穿心莲内酯

解析：本题考查的是二萜类化合物。结构为二萜类化合物的是紫杉醇（A对）与穿心莲内酯（B对）。二萜：是指骨架由4个异戊二烯单位构成，含20个碳原子的一类萜类衍生物。绝大多数不能随水蒸气蒸馏。二萜多以树脂、内酯或苷等形式广泛存在于自然界。不少二萜含氧衍生物具有很好的生物活性，如穿心莲内酯、芫花酯、雷公藤内酯、银杏内酯、紫杉醇等。苯丙酸（C错）、苯乙酸（D错）和苯甲酸（E错）属于有机酸。